女，18岁，未婚。月经规律，无停经史。突发下腹部疼痛伴恶心、呕吐8小时。查体：P78次/分，BP100/70mmHg，直肠－腹部触诊：子宫前位，正常大小，右侧附件区触及一个6cm×5cm×5cm囊实性包块，边界清楚，触痛明显。最可能的诊断是
A. 卵巢黄体破裂
B. 输卵管妊娠破裂
C. 急性阑尾炎
D. 卵巢肿瘤蒂扭转
E. 浆膜下子宫肌瘤

正确答案：D。卵巢肿瘤蒂扭转

解析：成年女性患者，未婚。月经规律，无停经史。突发下腹部疼痛伴恶心、呕吐，查体：右侧附件区触及一个囊实性包块，边界清楚，触痛明显。综合患者的症状、体征和辅助检查，最可能的诊断是卵巢肿瘤蒂扭转（D对）。卵巢黄体破裂（A错）月经不调。输卵管妊娠破裂（B错）可表现为停经、肛门坠胀感、阴道流血。急性阑尾炎（C错）表现为转移性右下腹痛。浆膜下子宫肌瘤（E错）的肿块为实质性。